药物依赖
A. 哌替啶
B. 吗啡
C. 两者皆有
D. 两者皆无

正确答案：C。两者皆有